治疗乳岩正虚毒炽证，应首选的方剂是
A. 神效瓜蒌散
B. 二仙汤
C. 八珍汤
D. 人参养荣汤
E. 参苓白术散

正确答案：C。八珍汤

解析：神效瓜蒌散适用于乳岩肝郁痰凝证（A错）。二仙汤适用于乳岩冲任失调证（B错）。八珍汤适用于乳岩正虚毒恋证（C对）。人参养荣汤适用于气血两亏证（D错）。参苓白术散适用于脾胃虚弱证（E错）。